以下哪项不是健康教育与健康促进的意义
A. 是卫生事业发展的战略举措
B. 是实现初级卫生保健的基础
C. 是丰富和充实理论知识，提高实践水平的重要途径
D. 是提高公民素养的重要渠道
E. 是一项低投入、高产出、高效益的保健措施

正确答案：C。是丰富和充实理论知识，提高实践水平的重要途径